血清肌钙蛋白I（cTnI）增高的临床意义是
A. 急性心肌梗死
B. 急性胰腺炎
C. 急性肾衰竭
D. 急性脑梗死
E. 急性胃肠炎

正确答案：A。急性心肌梗死

解析：本题考查的是常用血液生化检查。血清肌钙蛋白I（cTnI）增高的临床意义是急性心肌梗死（A对）。心肌肌钙蛋白I（cTnI）的临床意义：1.诊断急性心肌梗死（AMI）：AMI发病后3～6小时，cTnI即可升高，14～20小时达峰值，5～7天恢复正常。cTnI升高诊断AMI的特异性为93%～96%。2.判断微小心肌损伤：不稳定型心绞痛患者出现cTnI升高，表示心肌微小损伤。3.其他：急性心肌炎患者也可出现cTnI低水平升高。淀粉酶（AMY）的临床意义：1.活性增高：（1）诊断胰腺炎：①急性胰腺炎（B错）是AMY增高的最常见原因；②其他：慢性胰腺炎急性发作、胰腺囊肿、胰腺管阻塞时AMY也可升高。（2）胰腺癌早期AMY增高，是由于肿瘤压迫造成胰腺管阻塞和短时间内大量胰腺组织破坏所致。（3）其他：见于急腹症（病变累及胰腺）、乙醇中毒、肾衰竭（C错）（肾排泄AMY减少）。2.活性降低：慢性胰腺炎、胰腺癌分别因胰腺组织严重破坏或胰腺组织纤维化，导致胰腺分泌功能下降。稀糊状或水样粪便的临床意义：常由肠蠕动亢进、水分吸收不充分所致，见于各种肠道感染性或非感染性腹泻，或急性胃肠炎（E错）；若出现大量的黄绿色稀便并含有膜状物则应考虑伪膜性肠炎症；大量水样便也可见于艾滋病患者的肠道孢子虫感染。